下列各项，不属生活所伤导致妇科病的是
A. 饮食不节
B. 劳逸失常
C. 内伤七情
D. 房劳多产
E. 跌仆损伤

正确答案：C。内伤七情

解析：生活失调可以影响脏腑气血的正常功能，引起妇产科疾病。包括（1）房劳多产（D对）。（2）饮食不节（A对）。（3）劳逸失度（B对）。（4）跌仆损伤（E对）。（5）药误虫蚀（C错，为本题正确答案）。